行胃大部切除的患者不会发生的功能变化是
A. 胃蛋白酶原的分泌减少
B. 铁的吸收减少
C. 胰液中HCO3⁻的分泌增多
D. 维生素B12的吸收减少
E. 食物蛋白的消化减弱

正确答案：C。胰液中HCO3⁻的分泌增多

解析：胃大部切除术的切除范围为远端2/3～3/4胃组织并包括幽门、近胃侧部分十二指肠球部，行胃大部分切除手术可将含有主细胞和壁细胞的泌酸腺全部切除。其中，主细胞主要功能为分泌胃蛋白酶原，所行胃大部切除术的患者胃蛋白酶原的分泌减少（A错），进而导致胃蛋白酶原转化为具有消化蛋白功能的胃蛋白酶减少，因此行胃大部切除术的患者对食物蛋白的消化减弱（E错）。壁细胞的主要功能为分泌胃酸，胃酸可以促进铁的溶解和吸收，胃大部切除术后分泌胃酸的壁细胞减少，进而导致铁的吸收减少（B错）。壁细胞分泌的胃酸也是刺激促胰液素分泌的最强因素，促胰液素可以促使胰腺小导管细胞分泌大量的水和HCO₃⁻，因此胃大部切除的患者会导致HCO₃⁻的分泌减少（C对）。壁细胞在分泌胃酸的同时还分泌内因子，内因子可以结合维生素B₁₂，使其不被降解，从而促进其吸收。当胃大部切除术后，缺乏壁细胞导致内因子分泌减少，维生素B₁₂的吸收减少（D错）。